可使人群对传染病易感性降低的因素有
A. 预防接种
B. 病原体变异
C. 新生儿增加
D. 免疫人口的死亡
E. 易感人口的迁入

正确答案：A。预防接种

解析：本题考查引起人群易感性变化的因素。会引起人群易感性降低的因素包括：预防接种（A对）和传染病流行过后。引起人群易感性升高的因素包括：病原体变异（B错）、新生儿增加（C错）、免疫人口死亡（D错）和易感人口的迁入（E错）。